高钙血症对骨骼肌膜电位的影响是
A. 静息电位负值变大
B. 静息电位负值变小
C. 阈电位负值变大
D. 阈电位负值变小
E. 对膜电位无影响

正确答案：D。阈电位负值变小

解析：钙离子可抑制钠离子内流，高钙血症时，钠离子内流减少，通道开放时可有更多的钠内流，阈电位负值变小（D对C错）。